女性，48岁，反复咳嗽、咳痰、咯血20年，再发咯血3天就诊。查体，体温37.8℃，左下肺可闻及湿啰音。杵状指。该患者最可能的诊断是
A. 慢性支气管炎
B. 支气管扩张
C. 肺脓肿
D. 肺结核
E. 肺癌

正确答案：B。支气管扩张

解析：A项很少咯血。C项多急性起病有高热，咳大量浓臭痰。D项多有低热盗汗等全身中毒症状。E项多为痰中带血或间断血痰，侵蚀大血管时可发生大咯血。支扩有慢性咳嗽、大量浓痰、咯血等临床表现。体征：病变重或继发感染时常于胸下部或背部闻及湿啰音。部分患者有杵状指。故选B。掌握“支气管扩张”知识点。